男，58岁。上腹胀、隐痛2个月，伴食欲减退、乏力、消瘦、大便发黑。查体：消瘦，浅表淋巴结无肿大。上消化道钡剂造影见胃窦部小弯侧黏膜紊乱，可见直径3.5cm不规则充盈缺损，胃壁僵直。其最常见的转移途径是
A. 胃肠道内转移
B. 淋巴转移
C. 直接浸润
D. 血行转移
E. 腹腔内种植

正确答案：B。淋巴转移

解析：老年病人，有上腹隐痛，伴食欲减退、乏力、消瘦，消化道出血症状，钡剂造影显示有不规则充盈缺损（提示有溃疡），直径3.5cm＞2cm（恶性溃疡直径常＞2cm），胃壁僵直，应考虑有胃癌可能。胃癌最常见的转移途径是淋巴转移（B对）。